关于头面部痛温觉和触压觉传导通路的3级神经元，下列哪个不正确
A. 三叉神经脑桥核
B. 三叉神经脊束核
C. 丘脑腹后内侧核
D. 三叉神经节细胞
E. 对侧眼鼻侧半视野偏盲

正确答案：E。对侧眼鼻侧半视野偏盲

解析：头面部的痛温觉和触压觉传导通路第 1 级神经元为三叉神经节细胞（D对），第 2 级神经元的胞体在三叉神经脊束核（B对）和三叉神经脑桥核（A对），第 3 级神经元的胞体在背侧丘脑的腹后内侧核（C对），一侧视束及以后的视觉传导路（视辐射、视区皮质）受损，可致双眼病灶对侧眼鼻侧半视野偏盲（E错，为本题正确答案）。